根管充填术根管预备时常用的冲洗药物是
A. 0.3%过氧化氢溶液
B. 3%过氧化氢溶液
C. 5%过氧化氢溶液
D. 6%次氯酸钠
E. 6%次氯酸钙

正确答案：B。3%过氧化氢溶液

解析：本题考查根管冲洗的冲洗剂的选择。根管充填术根管预备时常用的冲洗药物是3%过氧化氢溶液（B对）。3%过氧化氢（AC错）遇到组织中的过氧化氢酶时可释放出新生氧，起到杀菌和除臭的作用。常用根管冲洗剂：1.0.5%～5.25%的次氯酸钠；2.17%的乙二胺四乙酸（EDTA）（D错）；3.3%过氧化氢；4.氯己定溶液（E错）。